结核菌素试验可用于
A. 接种卡介苗后免疫效果评价的指标
B. 婴幼儿结核病诊断的参考指标
C. 评价肿瘤患者非特异性细胞免疫功能的指标
D. 在未接种卡介苗的人群中作结核菌感染的流行率调查
E. 以上都正确

正确答案：E。以上都正确

解析：结核菌素试验可用于：①选择卡介苗的接种对象，并作为接种卡介苗后免疫效果评价的指标；②婴幼儿结核病诊断的参考指标；③评价肿瘤患者非特异性细胞免疫功能的指标；④在未接种卡介苗的人群中作结核菌感染的流行率调查。掌握“结核、非结核分枝杆菌”知识点。